获得性膜的功能包括
A. 修复和保护釉质表面
B. 为釉质提供有选择的渗透性
C. 影响微生物对牙面的附着
D. 作为菌斑微生物的底物和营养等
E. 以上都是

正确答案：E。以上都是

解析：本题考查获得性膜的功能。获得性膜可以使釉质通透性降低，对酸的敏感性也降低，使获得性膜能修复和保护釉质表面（A对）。获得性可为釉质提供有选择的渗透性（B对）。获得性膜的存在影响特异性口腔微生物对牙面的附着（C对），但主要取决于微生物的种类和表面的类型。获得性膜作为菌斑微生物的底物和营养等（D对）。（ABCD均对，故E为本题的正确答案）